重症肌无力患者出现反拗危象时的正确治疗原则是
A. 鼻饲大剂量吡啶斯的明和人工辅助呼吸
B. 肌注新斯的明和人工辅助呼吸
C. 静脉注射腾喜龙和人工辅助呼吸
D. 静脉注射洛贝林和人工辅助呼吸
E. 人工辅助呼吸

正确答案：E。人工辅助呼吸

解析：反拗危象是由于对抗胆碱酯酶药物不敏感而出现严重的呼吸困难。重症肌无力出现反拗危象应注意呼吸道畅通，当早期处理病情无好转时，应立即进行气管插管或气管切开，应用人工呼吸器辅助呼吸（E对），同时，停用吡啶斯的明（A错）、新斯的明（B错）、腾喜龙（C错）等抗胆碱酯酶药物以减少气管内的分泌物，选用有效足量和对神经-肌肉接头无阻滞作用的抗生素积极控制肺部感染，给予皮质类固醇激素或大剂量丙种球蛋白等静脉药物治疗，必要时采用血浆置换。洛贝林（D错）属于呼吸兴奋药，不用于呼吸肌无力的重症肌无力患者，否则会加重呼吸肌无力状况。